关于咽旁间隙的界限的叙述，正确的是
A. 后为椎前筋膜
B. 间隙呈倒立锥体形
C. 咽腔侧方的咽上缩肌与翼内肌和腮腺深叶之间
D. 前界为翼下颌韧带肌下颌下腺上缘
E. 以上均正确

正确答案：E。以上均正确

解析：咽旁间隙位于咽腔侧方的咽上缩肌与翼内肌和腮腺深叶之间。前界为翼下颌韧带肌下颌下腺上缘；后为椎前筋膜。间隙呈倒立锥体形，底在上为颅底的颞骨和蝶骨，尖向下止于舌骨。掌握“颞间隙、咽旁间隙感染”知识点。